30岁男性患者段某，因口腔黏膜反复溃烂两年就诊，检查：右舌缘有小溃疡2个，溃疡微凹，表现黄色假膜，触痛明显。眼部结膜炎，面部有疖肿，外生殖器有溃疡，该患者应考虑诊断
A. 淋病
B. 白塞病
C. 带状疱疹
D. 疱疹性口炎
E. 复发性口腔溃疡

正确答案：B。白塞病

解析：本题考查白塞病。患者口腔黏膜溃疡症状和发作规律与复发性阿弗他溃疡类似（都有周期性、复发性且溃疡表面被覆假膜），生殖器有溃疡，眼部有结膜炎，面部有疖肿，根据典型的口-眼-生殖器三联症该患者应考虑诊断为白塞病（B对）。淋病（A错）主要表现为泌尿生殖系统感染，无眼部症状。带状疱疹（C错）表现为沿单侧神经分布的簇集性小水疱，无眼部和生殖器症状。疱疹性口炎（D错）表现为似针头大小的成簇小水疱，不久破溃，形成浅表溃疡，但溃疡无复发性，且无眼部和生殖器症状。复发性口腔溃疡（E错）表现为反复发作的圆形或椭圆形溃疡，具有黄红凹痛的特征，即溃疡表面覆盖黄色假膜、周围有红晕带、中央有凹陷、疼痛明显，有周期性、复发性、自愈性，无特征性的眼部和生殖器症状。